患者，男，30岁。颈部肿块，溃后脓水清稀，夹有败絮样物质，经久不敛。应首先考虑的是
A. 发
B. 瘰疬
C. 颈痈
D. 失荣
E. 无头疽

正确答案：B。瘰疬

解析：该患者肿块发于颈部，故（AE错），瘰疬后期肿溃后，脓水清稀，夹有败絮样物，若成窦道，愈不易收敛（B对）。颈痈肿溃后，脓出黄白稠厚（C错）。患者无形体消瘦，面容憔悴的症状，且失荣肿溃后为脓血水（D错）。